烧伤后铜绿假单胞菌感染，抗生素治疗首选
A. 红霉素
B. 青霉素
C. 美西律
D. 甲氧苄啶
E. 头孢他啶

正确答案：E。头孢他啶

解析：烧伤后铜绿假单胞菌感染，首选β-内酰胺类抗生素（头孢他啶）治疗（E对）。